香砂养胃颗粒的功能是
A. 温中补虚
B. 温中益气
C. 理气化湿
D. 清胃理气
E. 温中和胃

正确答案：E。温中和胃

解析：本题考查香砂养胃颗粒的功能。香砂养胃颗粒的功能是温中和胃（E对）。香砂养胃颗粒（丸）【功能】温中和胃。小建中合剂【功能】温中补虚（A错），缓急止痛。香砂平胃丸（颗粒）【功能】理气化湿（C错），和胃止痛。